患者，男，66岁，BMI24kg/m²，高血压病史15年，冠心病史3年，目前规律服用阿司匹林、贝那普利、氨氯地平、美托洛尔、阿托伐他汀、螺内酯、呋塞米、单硝酸异山梨酯治疗。患者饮酒饱餐后出现胸闷，心前区疼痛，自服1片硝酸甘油不能缓解，来急诊科就诊。查体：血压163/83mmHg，心率80次1分。临床诊断为：（1）心绞痛急性发作；（2）心功能不全、心功能Ⅲ级；（3）高血压病3级；（4）高脂血症。该患者的治疗药物中，可抑制心肌重构，改善左室功能的药物是
A. 氨氯地平
B. 美托洛尔
C. 阿托伐他汀
D. 呋塞米
E. 单硝酸异山梨酯

正确答案：B。美托洛尔

解析：本题考查美托洛尔。美托洛尔（B对）是β受体阻断剂，可抑制心肌重构，改善临床左室功能，进一步降低总死亡率、降低心脏猝死率。氨氯地平（A错）属于钙通道阻滞剂，能够松弛血管平滑肌，发挥抗心绞痛作用；同时也能够降低血压，用于高血压的治疗。阿托伐他汀（C错）属于羟甲基戊二酰辅酶A还原酶抑制剂，对动脉粥样硬化及冠心病的防治产生作用，还能够稳定和缩小动脉粥样硬化的脂质斑块，减少心血管事件发生。呋塞米（D错）为常用的速效利尿剂。单硝酸异山梨酯（E错）临床主要用于预防缺血发生。